补中益气汤组成中含有的药物是
A. 当归，枳壳
B. 当归，人参
C. 人参，川芎
D. 当归，苍术
E. 山药，白术

正确答案：B。当归，人参

解析：本题考查补中益气汤的组成，记忆即可。补中益气汤由黄芪、白术、陈皮、升麻、柴胡、人参、甘草、当归（B对）组成。趣记：不种参草沉（陈）住（术）气（芪），升麻当柴烧